深层地下水是指
A. 位于地表面以下的水
B. 位于第一个不透水层以上的水
C. 位于第一个不透水层以下的水
D. 位于地层中的水
E. 位于第二个不透水层以上的水

正确答案：C。位于第一个不透水层以下的水

解析：本题考查深层地下水。深层地下水是指在第一个不透水层以下的地下水（C对ABDE错），其水质透明无色，水温恒定，细菌数很少，但盐类含量高，硬度大。